舌中部生芒刺者是
A. 肝胆火盛
B. 心火亢盛
C. 肺热壅盛
D. 胃肠热盛
E. 膀胱湿热

正确答案：D。胃肠热盛

解析：舌生点刺是邪热炽盛、充斥舌络所致，一般舌中生点刺，多为胃肠热盛（D对）。舌边有点刺，多属肝胆火盛（A错）。舌尖生点刺，多为心火亢盛（B错）。肺热雍盛可表现为舌红苔黄，一般无点刺（C错）。膀胱湿热可表现为舌红苔黄腻，一般无点刺（E错）。